最易引起输血后肝炎的病毒是
A. HAV
B. HBV
C. HCV
D. HDV
E. HEV

正确答案：C。HCV

解析：丙型肝炎病毒（HCV），丙型肝炎潜伏期为2～26周，平均6～7周。丙型肝炎与乙型肝炎的传播途径相似，但其母-婴传播率较低，主要经输血、脏器移植、血液透析、血制品及污染注射器等传播。掌握“丙型、丁型、戊型肝炎病毒”知识点。